下列关于利用儿童生长发育的环境因素，错误的建议是
A. 提供儿童充足的高糖、高脂、高蛋白食品
B. 让儿童青少年远离装修等污染源
C. 避免儿童膳食热能供给大幅度波动
D. 避免儿童从事剧烈的体育锻炼
E. 合理安排儿童的作息时间

正确答案：A。提供儿童充足的高糖、高脂、高蛋白食品